治疗脑水肿、降低颅内压的首选药物是
A. 螺内酯
B. 甘露醇
C. 氨苯蝶啶
D. 阿米洛利
E. 呋塞米

正确答案：B。甘露醇

解析：本题考查利尿药的临床作用。治疗脑水肿、降低颅内压的首选药物是甘露醇（B对）。甘露醇为渗透性利尿药，是治疗脑水肿、降低颅内压的安全而有效的首选药物。螺内酯（A错）为醛固酮的竞争性拮抗药，主要用于与醛固酮升高有关的顽固性水肿。氨苯蝶啶（C错）在临床上用于治疗各种水肿，常与排钾利尿药合用治疗顽固性水肿。阿米洛利（D错）临床用于治疗充血性心力衰竭、肝硬化腹水和肾病综合征等水肿性疾病以及肾上腺糖皮质激素治疗过程中发生的水钠潴留。呋塞米（E错）为常用的速效利尿剂，主要用于急性肺水肿和脑水肿、急慢性肾衰竭、加速毒物排泄等。